meta分析在合并各个独立研究结果前应进行
A. 异质性检验
B. 相关性检验
C. 森林图示研究
D. 回归分析
E. 标准化

正确答案：A。异质性检验